某男，70岁。患便秘20年，刻下大便秘结，腹痛拒按，腹胀纳呆，口干苦，小便短赤，舌红苔黄，脉滑数。证属胃肠实热积滞，治当宽中理气、泻下通便，宜选用的成药是
A. 舟车丸
B. 通便宁片
C. 通便灵胶囊
D. 九制大黄丸
E. 增液口服液

正确答案：B。通便宁片

解析：本题考查的是通便宁片的主治。患便秘20年，刻下大便秘结，腹痛拒按，腹胀纳呆，口干苦，小便短赤，舌红苔黄，脉滑数。证属胃肠实热积滞，治当宽中理气、泻下通便，宜选用的成药是通便宁片（B对）。通便宁片：【主治】肠胃实热积滞所致的便秘，症见大便秘结、腹痛拒按、腹胀纳呆、口干苦、小便短赤、舌红苔黄、脉弦滑数。舟车丸（A错）：【主治】水停气滞所致的水肿，症见蓄水腹胀、四肢浮肿、胸腹胀满、停饮喘急、大便秘结、小便短少。通便灵胶囊（C错）：【主治】热结便秘，长期卧床便秘，一时性腹胀便秘，老年习惯性便秘。九制大黄丸（D错）：【主治】胃肠积滞所致的便秘、湿热下痢、口渴不休、停食停水、胸热心烦、小便赤黄。增液口服液（E错）：【主治】高热后，阴津亏损所致的便秘，症见大便秘结，兼见口渴咽干、口唇干燥、小便短赤、舌红少津。